毛果芸香碱临床上主要用于治疗
A. 重症肌无力
B. 青光眼
C. 术后腹胀气
D. 房室传导阻滞
E. 有机磷农药中毒

正确答案：B。青光眼

解析：低浓度的毛果芸香碱可滴眼用于治疗闭角型青光眼，用药后使患者瞳孔缩小、前房角间隙扩大，眼内压下降。但高浓度时可造成患者症状加重，故不宜使用。本品对开角型青光眼早期也有一定疗效，但机制未明。掌握“毛果芸香碱”知识点。